女，26岁。人工流产术后3个月后，出现阴道流血，B超检査可见子宫肌壁有不均匀密集光点或暗区蜂窝状。患者属于
A. 吸宫不全
B. 侵袭性葡萄胎
C. 葡萄胎
D. 绒癌
E. 异位妊娠

正确答案：D。绒癌

解析：患者为年轻女性，人工流产术后3个月（为非葡萄胎妊娠），出现阴道流血（妊娠滋养细胞肿瘤在葡萄胎排空、流产或足月产后，有持续的不规则阴道流血，量多少不定），B超检査可见子宫肌壁有不均匀密集光点或暗区蜂窝状（B超显示肌层内有回声不均匀区域或团块），考虑为妊娠滋养细胞肿瘤，其包括侵蚀性葡萄胎和绒癌，而侵蚀性葡萄胎（B错）只继发于葡萄胎；非葡萄胎妊娠只继发绒癌（D对）。吸宫不全（P384）（A错）指人工流产术后部分妊娠组织物的残留。表现为术后阴道流血时间长，血量多或流血停止后再现多量流血。葡萄胎（P336）（C错）典型表现为停经后不规则阴道流血、子宫大于停经月份，而不是人流半年后阴道流血；异位妊娠（P53）（E错）早期常无特殊的临床表现，与早孕或先兆流产相似，晚期发生破裂时，突感一侧下腹部撕裂样疼痛，伴恶心呕吐，常有不规则阴道流血，两者B超检查均不会出现子宫肌壁有不均匀密集光点或暗区蜂窝状。